机体的各种因素对药物作用亦有很大影响，包括
A. 年龄差异
B. 性别差异
C. 耐受性差异
D. 职业差异
E. 个体差异

正确答案：A、B、C、E。年龄差异；性别差异；耐受性差异；个体差异